通过激动中枢α₂受体而降压的药物是
A. 可乐定
B. 美加明
C. 利血平
D. 卡托普利
E. 氢氯噻嗪

正确答案：A。可乐定

解析：本题考查可乐定。可乐定（A对）的降压机制为作用于中枢神经系统，激活血管运动神经中枢α₂受体，减少交感神经冲动传出，从而降低血压；美加明（B错）为神经节阻断药；利血平（C错）的降压作用主要依赖于使交感神经末梢囊泡内的神经递质（去甲肾上腺素）释放增加，阻止该物质进入囊泡，而使囊泡内神经递质逐渐减少或耗竭，导致交感神经冲动传导受阻，从而达到降压作用；卡托普利（D错）降低血压作用为抑制血管紧张素转换酶的活性；氢氯噻嗪（E错）为噻嗪类利尿药，通过减少血容量而降压，长期用药则通过扩张外周血管而产生降压作用。